无芽孢厌氧菌正常寄居的部位不包括
A. 肠道
B. 腹腔
C. 阴道
D. 尿道
E. 上呼吸道

正确答案：B。腹腔

解析：本题考查无芽孢厌氧菌正常寄居的部位。无芽孢厌氧菌正常寄居的部位包括皮肤、口腔、上呼吸道（E对）、肠道（A对）、阴道（C对）、尿道（D对）等，不包括腹腔（B错，为本题的正确答案），正常寄生位置的无芽孢厌氧菌一旦移位至腹腔，可引起内源性感染。